在疾病的预防措施中，EPI指的是
A. 流行
B. 流行病学
C. 扩大免疫计划
D. 预防接种
E. 被动免疫

正确答案：C。扩大免疫计划